手足不温，腹痛泄利下重，脉弦者，治宜选用
A. 健脾丸
B. 保和丸
C. 四逆散
D. 痛泻要方
E. 葛根黄芩黄连汤

正确答案：C。四逆散

解析：痛泻要方含炒白术、炒芍药、炒陈皮、防风，以补脾柔肝，祛湿止泻，主治脾虚肝郁之痛泻。手足不温，肠鸣腹痛，大便泄泻，泻必腹痛，泻后痛缓，舌苔薄白，脉两关不调，左弦而右缓者（D错）。健脾丸功用为健脾和胃，消食止泻（A错）。保和丸功用为消食化滞，理气和胃（B错）。四逆散功用为透邪解郁，疏肝理脾，主治阳郁厥逆证，手足不温，或腹痛，或泄利下重，脉弦；肝脾气郁证（C对）。葛根黄芩黄连汤功用为解表清里，主治表证未解，邪热入里证（E错）。